有关心脏杂音的叙述，不正确的是
A. 杂音可因血流加速而产生
B. 杂音可因血液反流而产生
C. 杂音的响亮程度与心脏病变成正比
D. 杂音有生理性的
E. 病变的瓣膜不同，杂音的部位也不同

正确答案：C。杂音的响亮程度与心脏病变成正比

解析：心脏杂音是指除心音与额外心音外，在心脏收缩或舒张过程中的异常声音，其特点为：①杂音可因血流加速而产生（A对）；②杂音可因血液反流而产生（B对）；③杂音有生理性的（D对）；④病变的瓣膜不同，杂音的部位也不同（E对）；⑤有时杂音的强度不一定与心脏病变成正比（C错，为本题正确答案）。